引起人体器官或组织出现功能性改变的不良反应，属
A. 人体组织学分类的不良反应
B. 病因学分类的不良反应
C. 病理学分类的不良反应
D. 临床表现分类的不良反应
E. 药物分类的不良反应

正确答案：C。病理学分类的不良反应

解析：本题考查的是药物不良反应的分类。引起人体器官或组织出现功能性改变的不良反应，属病理学分类的不良反应（C对）。中药药物不良反应的病理学分类：（1）功能性改变：系指药物引起人体的器官或组织功能发生改变。（2）器质性改变：系指药物引起人体器官或组织出现病理性器质改变。中药药物不良反应的病因学分类（B错）：（1）与药物剂量有关的中药不良反应：该类型由药物本身或其代谢物所引起，使固有药理作用持续和增强。其不良反应包括药物的副作用、毒性作用，以及继发反应、首剂效应、后遗作用等。（2）与药物剂量无关的中药不良反应：该类型与药物固有的正常药理作用无关，而与药物变性（如药物有效成分降解产生有害物质）和人体特异体质（指患者的特殊遗传素质）有关。此类伤害又可分为两种。①特异质反应：指由于遗传因素机体产生的不良反应。②变态反应：亦称药物过敏反应。人体组织学分类（A错）、临床表现分类（D错）、药物分类的不良反应（E错）均不属于药物的不良反应分类。